抗结核病化学治疗的作用包括
A. 防止结核变异菌株产生耐药
B. 早期迅速杀灭结核分枝杆菌
C. 消灭体内持留菌，最大限度减少复发
D. 提高患者的用药依从性
E. 促进循环免疫复合物形成和自身抗体的形成

正确答案：A、B、C。防止结核变异菌株产生耐药；早期迅速杀灭结核分枝杆菌；消灭体内持留菌，最大限度减少复发

解析：本题考查抗结核病化学治疗的作用。结核病应用化学治疗的主要作用有以下三个方面：1.杀菌作用，迅速杀死病灶中大量繁殖的结核分枝杆菌（B对）使患者由传染性转为非传染性，减轻组织破坏，缩短治疗时间，临床表现为痰菌迅速转阴。2.防止耐药菌产生，防止获得性耐药变异菌的出现是保证治疗成功的重要措施（A对）。3.灭菌。彻底杀灭结核病中半静止和代谢缓慢的结核分枝杆菌是化学治疗的最终目的，使完成规定疗程后无复发和复发率很低（C对）。